对一氧化碳中毒有确诊价值的是
A. 血氧饱和度下降
B. 皮肤粘膜樱桃红色
C. 呼吸困难
D. 血氧合血红蛋白浓度降低
E. 血碳氧血红蛋白浓度升高

正确答案：E。血碳氧血红蛋白浓度升高

解析：一氧化碳与血红蛋白的亲和力比氧与血红蛋白的亲和力大240倍，吸入较低浓度的CO即可产生大量的碳氧血红蛋白，且碳氧血红蛋白不易解离，血液中碳氧血红蛋白浓度升高（E对）对一氧化碳中毒有诊断价值，且有助于分型和估计预后。血氧饱和度下降（A错）、血氧合血红蛋白浓度降低（D错）可由于氧的供给不足，血红蛋白不能充分发挥作用或可与氧结合的血红蛋白减少所致，可出现在一氧化碳中毒、缺氧及慢性肺心病等疾病中；皮肤黏膜樱桃红色（B错）是一氧化碳中毒的特征性临床表现，是由于一氧化碳与血红蛋白结合呈樱桃红色的碳氧血红蛋白所致，其本质还是碳氧血红蛋白含量增加；在一氧化碳中毒中，氧含量下降，但氧分压正常，由于外周呼吸感受器感受的是氧分压而不是氧含量，所以不会刺激呼吸感受器引起呼吸困难（C错）。